不属于轮状病毒特点的是
A. 为RNA病毒，含11个片段
B. 为6月龄至2岁婴幼儿腹泻的最重要的病原体
C. 主要经粪口途径传播
D. 呈杆形，直径70～75nm
E. 可引起婴幼儿腹泻

正确答案：D。呈杆形，直径70～75nm

解析：轮状病毒呈球形，直径60～80nm，核心为双股RNA（dsRNA），由11个基因片段组成，外有双层衣壳呈车轮辐条状，故称为轮状病毒。只有具有双层衣壳结构的完整病毒颗粒才有感染性。轮状病毒引起急性胃肠炎，主要传播途径为粪-口传播。轮状病毒分为7个组（A～G），A～C组轮状病毒能引起人类和动物腹泻，D～G组只能引起动物腹泻。A组轮状病毒感染最为常见，它是6月龄至2岁婴幼儿腹泻的最重要的病原体。目前发展中国家婴幼儿死亡的主要原因之一。在温带地区秋冬季是疾病发生的主要季节，故曾称婴幼儿秋季腹泻。掌握“胃肠道病毒”知识点。